HLA复合体位于
A. 第4号染色体短臂
B. 第5号染色体短臂
C. 第6号染色体短臂
D. 第7号染色体短臂
E. 第7号染色体长臂

正确答案：C。第6号染色体短臂

解析：HLA复合体的定位和结构：HLA复合体位于第6号染色体短臂。掌握“HLA种类及其产物、医学意义”知识点。